男性，8岁，因牙龈及口腔黏膜坏死溃烂1周，伴高烧10天来诊。经检查初步诊断为坏死性龈口炎。口腔局部治疗时，以下哪种药物不适用
A. 3％过氧化氢
B. 1％龙胆紫
C. 10％硝酸银
D. 牙周塞制剂
E. 养阴生肌散或冰硼散

正确答案：C。10％硝酸银

解析：本题考查坏死性龈口炎的疾病管理。男性，8岁，因牙龈及口腔黏膜坏死溃烂1周，伴高烧10天来诊。经检查初步诊断为坏死性龈口炎。口腔局部治疗时，10%硝酸银（C错，为本题的正确答案）不适用。坏死性龈口炎是以梭状杆菌和螺旋体感染为主病因的急性坏死性溃疡性口腔病变。10％硝酸银虽有治疗作用，但是腐蚀性强，会损伤周围正常组织，并使黏膜着色，故不适用。3％过氧化氢（A对）、1％龙胆紫（B对）可以控制感染，收敛杀菌。去除牙间乳头和龈缘的坏死组织后使用牙周塞制剂（D对）可起到止血、止痛、保护创口、促进愈合的作用。养阴生肌散或冰硼散（E对）是中药疗法，有清热解毒祛腐的作用。这些药物均适用于坏死性龈口炎的治疗。